微循环中下列哪项结构主要受局部代谢产物的调节
A. 微动脉
B. 微静脉
C. 通血毛细血管
D. 毛细血管前括约肌
E. 真毛细血管

正确答案：D。毛细血管前括约肌

解析：微循环中后微动脉和毛细血管前括约肌（D对）主要受局部代谢产物的调节。后微动脉和毛细血管前括约肌收缩时，毛细血管关闭，导致毛细血管周围组织代谢产物积聚、O₂分压降低。而积聚的代谢产物和低氧状态，尤其是后者可反过来引起局部后微动脉和毛细血管前括约肌（D对）舒张，于是毛细血管开放，局部组织积聚的代谢产物被血流清除。接着后微动脉和毛细血管前括约肌又收缩，使毛细血管关闭，如此周而复始。微动脉（P127）（A错）主要受神经调节和体液调节，其是交感缩血管神经纤维分布密度最高的血管类型。较小的微静脉（B错）无血管平滑肌分布，不参与微循环血流量的调节，较大的微静脉有血管平滑肌主要受神经调节和体液调节。通血毛细血管（C错）即为后微动脉的移行部分，其管壁平滑肌逐渐减少至消失，其一般不受局部代谢产物的调节（P128）。真毛细血管（P127）（E错）管壁没有平滑肌，由单层内皮细胞构成，外面包被一薄层基膜，是血液和组织液之间进行交换的主要场所。